不属于混悬剂的物理稳定性的是
A. 混悬粒子的沉降速度
B. 微粒的荷电与水化
C. 混悬剂中药物的降解
D. 絮凝与反絮凝
E. 结晶生长与转型

正确答案：C。混悬剂中药物的降解

解析：本题考查混悬剂。不属于混悬剂的物理稳定性的是混悬剂中药物的降解（C错，为本题正确答案）。药物的降解中药物发生了化学反应，导致了药物降解，不属于物理变化。混悬剂的物理稳定性包括：混悬粒子的沉降速度（A对）；絮凝与反絮凝（D对）；微粒的荷电与水化（B对）；结晶增长与转型（E对）。